已知人体血铅值仅以过高为异常，且其服从正偏态分布，若要估计某地成年人血铅含量的95%医学参考值范围，宜采用
A. ＞P5
B. P2.5～P97.5
C. P5～P95
D. ＜P95
E. ＜P97.5

正确答案：D。＜P95

解析：正态分布广泛应用于确定医学参考值范围。该题中人体血铅值服从正态分布，且以＞95%为异常，则只需确定＜P95为正常参考值范围（D对）。